肝的上界在右锁骨中线相交于
A. 第4肋
B. 第4肋间隙
C. 第5肋
D. 第5肋间隙
E. 无

正确答案：C。第5肋

解析：肝的上界有三种表示方法，一是右锁骨中线与第5肋(C对)交点，二是前正中线与剑胸结合线的交点，三是左锁骨中线与第5肋间隙(D错)的交点。